男，56岁。咳嗽伴痰中带血2周，胸部X线片及CT检查发现右肺上叶周围型结节，痰细胞学检查示：鳞癌可能性大。该患者首选治疗是
A. 免疫治疗
B. 手术治疗
C. 化学药物治疗
D. 介入治疗
E. 放射治疗

正确答案：B。手术治疗

解析：患者可能患有鳞癌，咳嗽伴痰中带血2周，X线片及CT示右肺上叶周围型结节，考虑可能为早期周围型肺癌。本题未提及有淋巴转移征象，默认一般情况良好，故该患者首选的治疗是手术治疗（B对），切除癌变肺叶。免疫治疗（A错）、化学药物治疗（C错）、放射治疗（E错）仅作为一般辅助治疗措施，不是该患者的首选治疗方案。肺不属于实质性脏器，不宜介入治疗（D错）。